拟拔除右下8所需麻醉的神经是
A. 下牙槽神经+舌神经
B. 下牙槽神经+颊神经
C. 下牙槽神经+颊神经+舌神经
D. 下牙槽神经+舌神经+颏神经
E. 下牙槽神经+舌神经+颊神经+咬肌神经

正确答案：C。下牙槽神经+颊神经+舌神经

解析：本题考查上、下颌神经在口腔的分布。拟拔除右下8所需麻醉的神经是下牙槽神经+颊神经+舌神经（C对）。舌神经支配48的舌侧牙龈和口底；颊神经支配48颊侧牙龈、颊部皮肤和黏膜；下牙槽神经支配48牙髓、牙周膜及牙槽骨。所以拔除48需麻醉的神经是下牙槽神经+颊神经+舌神经。